因缺失牙还可能引起邻牙间的接触点丧失造成
A. 美观的影响
B. 咀嚼功能减退
C. 发音功能障碍
D. 颞下颌关节病变
E. 对牙周组织的影响

正确答案：E。对牙周组织的影响

解析：对牙周组织的影响：因缺失牙还可能引起邻牙间的接触点丧失，食物嵌塞导致龈炎或牙周炎。掌握“牙列缺损病因及影响”知识点。